和解少阳的代表方剂是
A. 四逆散
B. 逍遥散
C. 大柴胡汤
D. 葛根芩连汤
E. 小柴胡汤

正确答案：E。小柴胡汤

解析：小柴胡汤方中柴胡苦平，透泄少阳之邪，并能疏泄气机之郁滞，使少阳之邪得以疏散，为君药。黄芩苦寒，清泄少阳之热，为臣药。胆气犯胃，胃失和降，佐以半夏、生姜和胃降逆止呕；邪从太阳传入少阳，缘于正气本虚，故又佐以人参、大枣益气补脾，一者取其扶卫以祛邪，一者取其益气以御邪内传，正气旺盛，则邪无内向之机。炙甘草助参、枣扶正，兼以调和诸药，用为佐使药。诸药合用，以和解少阳为主，兼和胃气，使邪气得解，则诸症自除（E对）。四逆散（A错）的功用为透邪解郁，疏肝理脾，主治阳郁厥逆证；肝脾不和证。逍遥散（B错）的功用为疏肝解郁，养血健脾，主治肝郁血虚脾弱证。大柴胡汤（C错）的功用为和解少阳，内泻热结，主治少阳阳明合病。葛根芩连汤（D错）的功用为解表清里，主治表证未解，邪热入里证。